女，30岁，人工流产术后闭经7个月，无腹痛，既往月经规律，尿妊娠试验阴性，基础体温双相型，最可能的诊断是
A. Asherman综合征
B. Sheehan综合征
C. 闭经-溢乳综合征
D. 空蝶鞍综合征
E. 多囊卵巢综合征

正确答案：A。Asherman综合征

解析：中青年女性，人工流产术后（诱因）闭经，尿妊娠试验阴性，基础体温双相型（提示有排卵）。综合病人的病史、临表、体检，最可能的诊断是Asherman综合征（A对）。Sheehan综合征（B错）是由于产后大出血休克，导致垂体尤其是腺垂体促性腺激素分泌细胞缺血坏死，引起腺垂体功能低下而出现一系列症状，可伴有严重而局限的眼眶后方疼痛、视野缺损及视力减退等症状，基础代谢率降低（P343）。闭经－溢乳综合征（C错）主要表现为闭经、溢乳、月经不调、月经减少，该患者既往月经正常且只存在闭经症状。空蝶鞍综合征（D错）属垂体性闭经，患者可出现闭经和高催乳素血症（P343）。多囊卵巢综合征（E错）以长期无排卵（基础体温单相型）及高雄激素血症为特征，临床表现为闭经、不孕、多毛和肥胖（P348）。